二重感染属于
A. 停药反应
B. 毒性反应
C. 副作用
D. 继发反应
E. 后遗效应

正确答案：D。继发反应

解析：本题考查继发反应。二重感染属于继发反应（D对）。继发反应是继发于药物治疗作用之后的不良反应，是治疗剂量下治疗作用本身带来的间接结果。例如，长期应用广谱抗生素，使敏感细菌被杀灭，而非敏感菌（如厌氧菌、真菌）大量繁殖，造成二重感染。停药反应（A错）是指患者长期应用某种药物，突然停药后出现原有疾病加剧的现象，又称回跃反应或反跳。毒性反应（B错）是指在药物剂量过大或体内蓄积过多时发生的危害机体的反应。副作用（C错）是指在药物按正常用法用量使用时，出现的与治疗目的无关的不适反应。后遗效应（E错）是指在停药后，血药浓度已降至最小有效浓度以下时残存的药理效应。